微型胶囊的特点不包括
A. 可提高药物的稳定性
B. 可掩盖药物的不良臭味
C. 可使液态药物固态化
D. 能使药物迅速到达作用部位
E. 减少药物的配伍变化

正确答案：D。能使药物迅速到达作用部位

解析：本题考查微囊的特点。微型胶囊的特点不包括能使药物迅速到达作用部位（D错，为本题正确答案）。药物微囊化的特点：1. 提高药物的稳定性（A对）；2.掩盖药物的不良臭味（B对）；3.防止药物在胃内失活， 减少药物对胃的刺激性；4.控制药物的释放；5.使液态药物固态化（C对）；6.减少药物的配伍变化（E对）；7.使药物浓集于靶区。